患者，男，31岁。目赤肿痛，羞明，流泪，伴头痛发热，脉浮数。治疗除取主穴外，还应选用的穴位是
A. 太渊、风池
B. 上星、少商
C. 行间、侠溪
D. 太溪、鱼腰
E. 外关、四白

正确答案：B。上星、少商

解析：该患者以目赤肿痛，羞明，流泪为主症，故诊断为目赤肿痛。头痛发热，脉浮数为外感风热之象，故辨为风热证。在主穴的基础上配少商、上星治疗目赤肿痛风热证，配行间、侠溪治疗目赤肿痛肝胆火盛证（B对）。肝胆火盛者加行间、侠溪（C错）。